通过抗氧化作用而发挥抗动脉粥样硬化作用的药物是
A. 考来烯胺
B. 洛伐他汀
C. 烟酸
D. 非诺贝特
E. 普罗布考

正确答案：E。普罗布考